幼年类风湿性关节炎的临床表现不包括
A. 贫血
B. 弛张热
C. 皮下结节
D. 多发性关节炎
E. 关节畸形强直

正确答案：C。皮下结节

解析：幼年特发性关节炎分为全身型关节炎、多关节型（类风湿因子阴性）、多关节型（类风湿因子阳性）、少关节型、与附着点炎症相关的关节炎、银屑病关节炎和未定类的幼年特发性关节炎，临床表现各有不同。幼年类风湿性关节炎的临床表现不包括皮下结节（C错，为本题正确答案），但其与高滴度血清类风湿因子、严重的关节破坏及类风湿活动性病变密切相关。急性期可有轻～中度贫血（A对）。弛张热（B对）见于全身型关节炎，每天体温波动在36℃～40℃。多发性关节炎（D对）为发热最初6个月5个关节受累，多为对称性，大小关节均可受累，女孩多见。关节畸形强直（E对）为幼年特发性关节炎的晚期严重表现。